属于闭合伤的是
A. 擦伤
B. 火器伤
C. 刺伤
D. 直肠破裂
E. 撕脱伤

正确答案：D。直肠破裂

解析：开放伤和闭合伤的根本区别在于是否有皮肤破损，皮肤完整无伤口者称闭合伤，有皮肤破损者称为开放伤。直肠破裂（D对）发生在腹腔内部，并没有皮肤破损，因而属于闭合伤（九版外科学P122）。擦伤（A错）、火器伤（B错）、刺伤（C错）和撕裂伤（E错）均有皮肤破损，属于开放伤。